关于中药注射剂特点和应用注意事项的说法，错误的是
A. 一般能口服用药的不选用注射给药
B. 中药注射剂应谨慎联合用药
C. 中药注射剂药效迅速，不易发生不良反应
D. 长期使用时，疗程间应有一定的间隔时间
E. 对于初次使用中药注射剂的患者应加强监测

正确答案：C。中药注射剂药效迅速，不易发生不良反应

解析：本题考查的是注射剂的临床应用注意事项。中药注射剂药效迅速，易发生不良反应（C错，为本题正确答案）。注射剂的临床应用注意事项：（1）选用中药注射剂应严格掌握适应证，合理选择给药途径。一般要求能口服给药的，不选用注射给药（A对）；能肌内注射给药的，不选用静脉注射或滴注给药。必须选用静脉注射或滴注给药的应加强监测。（2）辨证施药，严格掌握功能主治。严格按照药品说明书规定的功能主治使用，禁止超功能主治用药。（3）严格掌握注射剂用法用量及疗程。按照药品说明书推荐剂量、调配要求、给药速度、疗程使用药品。不得超剂量、过快滴注和长期连续用药。（4）中药注射剂应单独使用，不得与其他药品混合配伍使用。谨慎联合用药（B对），如确需联合使用其他药品时，应谨慎考虑与中药注射剂的间隔时间以及药物相互作用等问题。（5）用药前应仔细询问患者过敏史，对过敏体质者应慎用。（6）老人、儿童、肝肾功能异常患者等特殊人群和初次使用中药注射剂的患者应慎用并加强监测（E对）。长期使用时，在每疗程间应有一定的时间间隔（D对）。（7）加强用药监护。用药期间应密切观察用药反应，特别是用药开始30分钟。若发现异常，应立即停药，采用积极救治措施，救治患者。